50mg溶栓治疗后症状改善。此时应采取的治疗措施是
A. 口服华法林
B. 皮下注射低分子肝素
C. 口服氯吡格雷
D. 维持rt-PA静脉注射
E. 口服阿司匹林

正确答案：B。皮下注射低分子肝素

解析：肺栓塞至少需要抗凝3个月，溶栓后需立即开始规范的肝素抗凝治疗（B对）。华法林需要数天才能发挥全部作用，起效慢，故不适用于肺栓塞急性期（A错）。氯吡格雷用于预防和治疗因血小板聚集引起的心、脑及其他动脉循环障碍疾病，与阿司匹林一样，具有抗血小板聚集作用，属于非抗凝药物（CE错）。维持rt-PA静脉注射（D错）为溶栓的药物，症状改善后，应该停止应用，改用抗凝药物。